甲状腺功能亢进症气阴两虚证的治法是
A. 疏肝理气，化痰软坚
B. 清肝泻火，消瘿散结
C. 滋阴清热，软坚散结
D. 益气养阴，消瘿散结
E. 清肝泻火，化痰散结

正确答案：D。益气养阴，消瘿散结

解析：甲状腺功能亢进症气阴两虚证的机理为痰气郁结颈前日久，耗伤气津，故其治法为益气养阴，消瘿散结（D对），方药选用益气养阴的生脉散加减。疏肝理气，化痰软坚（A错）可用于治疗气滞痰凝证，代表方为逍遥散合二陈汤加减；清肝泻火，消瘿散结（B错）治疗肝火旺盛证，代表方为龙胆泻肝汤加减；滋阴清热，软坚散结（C错）治疗阴虚火旺证，代表方为天王补心丹加减；清肝泻火，化痰散结（E错）不属于甲状腺功能亢进症的治法。